属于内分泌腺的器官是
A. 前列腺
B. 垂体
C. 卵巢
D. 胰腺
E. 血流快

正确答案：B。垂体

解析：前列腺前列腺，是由腺组织和平滑肌组织构成的实质性器官，属于外分泌腺（P155）（A错）。胰是兼有内、外分泌功能的腺体，其外分泌部（腺细胞）能分泌胰液；内分泌部即胰岛，主要分泌胰岛素（P119）（D错）。卵巢内的卵泡和黄体等属于内分泌组织而不是内分泌腺（P406）（C错）。内分泌腺包括垂体、甲状腺、甲状旁腺、肾上腺、松果体、胸腺和生殖腺等（P406）（B对）。